治疗中风中脏腑元气衰脱，心神散乱证，应首选
A. 安宫牛黄丸
B. 参附汤
C. 苏合香丸
D. 清开灵（静脉滴注）
E. 安神丸

正确答案：B。参附汤

解析：参附汤合生脉散加减可以益气回阳，救阴固脱，用于治疗中风中脏腑元气衰脱，心神散乱证（B对）。安宫牛黄丸（A错）用于痰热内闭清窍证。苏合香丸（C错）用于痰湿瘀闭心神证。清开灵（静脉滴注）（D错）用于窍闭证。安神丸（E错）用于神志不安证。